采用舌杆时，下前牙舌杆距牙龈缘距离为
A. 2mm
B. 3～4mm
C. 5mm
D. 5～6mm
E. 7mm

正确答案：B。3～4mm

解析：舌杆：位于下颌舌侧龈缘与舌系带或黏膜皱襞之间。舌杆纵剖面呈半梨形，边缘薄而圆滑，距牙龈缘3～4mm。舌杆除口底浅，前牙向舌侧倾斜，或有明显舌隆突但外科手术不能去除者外，应用范围较广。舌杆与黏膜的接触关系，根据下颌舌侧牙槽骨形态而定。一般有三型：垂直型者舌杆与黏膜平行接触；倒凹型者舌杆在倒凹区之上，或在倒凹区，但要留出空隙；斜坡型者舌杆与黏膜离开0.3～0.4mm，与牙槽嵴平行。舌杆的位置要适宜，既不影响舌的运动，也不妨碍口底的功能活动。如在前牙舌隆突上放置连续舌支托则称隆突杆，与舌杆合并使用则称双舌杆，对前牙可起支持作用，亦有增加游离端基托稳定的作用。掌握“局部义齿连接体”知识点。